男性，50岁，左腮腺肿物4年。肉眼见肿瘤大体呈结节状或分叶状，包膜较完整；剖面灰白色，可见浅蓝色区及半透明胶冻样区，此表现应见于
A. 腺淋巴瘤
B. 多形性腺瘤
C. 基底细胞腺瘤
D. 导管乳头状瘤
E. 嗜酸性腺瘤

正确答案：B。多形性腺瘤

解析：患者的临床表现符合多形性腺瘤较典型的肉眼表现。而腺淋巴瘤不呈结节样外观，切面暗红色；基底细胞腺瘤、嗜酸性腺瘤和导管乳头状瘤切面多为实性，无浅蓝色表现。掌握“多形性腺瘤”知识点。